以下哪项不属于上颌骨的四个突起
A. 牙槽突
B. 喙突
C. 腭突
D. 额突
E. 颧突

正确答案：B。喙突

解析：上颌骨外形特点上颌骨形态不规则，可分为一体四突，四突：额突、颧突、腭突、牙槽突。掌握“上颌骨解剖特点”知识点。